迄今为止，黏合剂引起家居环境污染可能与下列健康效应无关
A. 不孕不育
B. 接触性皮炎
C. 过敏性皮炎
D. 支气管哮喘
E. 肿瘤

正确答案：A。不孕不育

解析：本题考查黏合剂引起家居环境污染对健康的影响。黏合剂指用于黏合两种或两种以上相同或不同材料的物质，即按照规定程序，把纸、布、皮革、木、金属、玻璃、橡皮或塑料之类的材料黏合在一起的物质。迄今为止，黏合剂引起家居环境污染可能与接触性皮炎（B对）、过敏性皮炎（C对）、支气管哮喘（D对）、肿瘤（E对）有关。不孕不育（A错，为本题正确答案）指一年以上未采取任何避孕措施，性生活正常而没有成功妊娠，与黏合剂无关。